2岁6个月男婴，体重8.5kg，身高80cm，明显消瘦，喜哭闹，皮肤苍白，腹壁皮下脂肪0.3cm
A. Ⅰ度营养不良
B. Ⅱ度营养不良
C. Ⅲ度营养不良
D. 恶性度营养不良
E. 正常儿

正确答案：B。Ⅱ度营养不良

解析：本题考查营养不良的分度。2岁6个月男婴的平均体重在10.7～16.6kg，该名男婴体重8.5kg，体重较平均体重减低15%～40%，身高80cm，明显消瘦，喜哭闹，皮肤苍白，腹壁皮下脂肪0.3cm，则属于Ⅱ度营养不良（B对ACDE错）。营养不良临床分为三度，具体如下：1.Ⅰ度营养不良为体重减低15%～25%，腹部皮褶厚度为0.4～0.8cm。2.Ⅱ度营养不良为体重减低15%～40%，腹部皮褶厚度小于0.4cm。3.Ⅲ度营养不良为体重减低比例＞40%，腹部皮褶消失。